肺气肿时，肺部叩诊音应是
A. 清音
B. 过清音
C. 浊音
D. 鼓音
E. 实音

正确答案：B。过清音

解析：肺气肿时，因含气量过多，肺部叩诊音应是过清音（B对A错）。胸腔积液、胸膜增厚等病变，叩诊呈浊音或实音（CE错）。气胸、胸膜腔积气叩诊呈鼓音（D错）。